下列有关颌面部放线菌病的表现中，不恰当的一项是
A. 20～45岁的男性多见
B. 软组织可见于下颌下、颈、舌及颊部
C. 从脓肿或瘘孔排出的脓液中可获得硫黄样颗粒
D. 患区触诊似板状硬，有压痛
E. 与周围正常组织分界清晰

正确答案：E。与周围正常组织分界清晰

解析：颌面部放线菌病临床表现：以20～45岁的男性多见。发生于面颈部的放线菌病占全身的60%以上。颌面部放线菌病主要发生于面部软组织，软组织与颌骨同时受累者仅占20%。软组织好发部位以腮腺咬肌区为多，其次是下颌下、颈、舌及颊部；颌骨的放线菌病则以下颌角及下颌支为多见。临床上多在腮腺及下颌角部出现无痛性硬结，表面皮肤呈棕红色，病程缓慢，早期无自觉症状。炎症侵及咬肌时，出现张口障碍，咀嚼、吞咽时可诱发疼痛。患区触诊似板状硬，有压痛，与周围正常组织无明显分界。掌握“颌面部骨结核、放线菌病”知识点。